分娩时最主要的产力是
A. 子宫收缩力
B. 肛提肌收缩力
C. 腹肌收缩力
D. 膈肌收缩力
E. 腹压力

正确答案：A。子宫收缩力

解析：产力包括子宫收缩力、腹肌收缩力、膈肌收缩力和肛提肌收缩力。分娩时最主要的产力是子宫收缩力（A对）。腹肌收缩力（C错）和膈肌收缩力（D错）统称腹压力（E错），是第二产程胎儿娩出的重要辅助力量。肛提肌收缩力（B错）主要是协助胎先露部在盆腔进行内旋转。